有颊、舌两个卡臂和一个铸造（牙合）支托的是哪种锻丝卡环形式
A. 连续卡环
B. 尖牙卡环
C. 双臂卡环
D. 三臂卡环
E. 圈形卡环以上为锻丝卡环的各种类型

正确答案：D。三臂卡环

解析：三臂卡环：有颊、舌两个卡环臂和一个铸造（牙合）支托。结构和作用与铸造三臂卡环相似。掌握“局部义齿固位体”知识点。